“帮助病人自我恢复”指的是
A. 主动—被动型医患关系
B. 指导—合作型医患关系
C. 共同参与型医患关系
D. 亲密—疏远型医患关系
E. 以上都不正确

正确答案：C。共同参与型医患关系

解析：共同参与型这是一种双向性的，以生物心理社会医学模式为指导思想的医患关系，其特征是“医生帮助病人自我恢复”，医患双方的关系建立在平等基础上，双方有近似相等的权利和地位，共同参与医疗决策和实施过程，相互尊重、相互依赖。掌握“医患沟通的理论、技术与其应用以及医患关系模式”知识点。